仅用于止咳的非处方药是
A. 对乙酰氨基酚
B. 布洛芬
C. 西咪替丁
D. 氢化可的松
E. 氢溴酸右美沙芬

正确答案：E。氢溴酸右美沙芬

解析：本题考查右美沙芬。仅用于止咳的非处方药是氢溴酸右美沙芬（E对）。氢溴酸右美沙芬为非依赖性中枢性镇咳药，镇咳作用于可待因相似，但无镇痛作用，适用于无痰干咳。对乙酰氨基酚（A错）为最常用的解热镇痛药。布洛芬（B错）为解热镇痛抗炎药，属于双跨药，用于治疗类风湿性关节炎是处方药，用于解热、镇痛是非处方药。西咪替丁（C错）为H₂受体拮抗剂。氢化可的松（D错）为糖皮质激素类药物。